下列不是胃食管反流病并发症的是
A. 胃癌
B. 食管狭窄
C. 食管腺癌
D. 消化道出血
E. Barrett食管

正确答案：A。胃癌

解析：发生胃食管反流时，胃内高酸液体入食管，腐蚀食管粘膜、肌层，导致食管瘢痕形成，食管狭窄（B对）。食管上皮主要以鳞状上皮为主，当食管粘膜受到胃液刺激后，刺激腺上皮增生，分泌粘液以抵抗胃液的腐蚀，使食管鳞状上皮发生腺上皮化生，腺上皮化生是癌前病变，容易发展为食管腺癌（C对）。食管粘膜内含有血管，当损伤侵及血管时，发生消化道出血（D对）。Barrett食管（E对）指的是食管下端鳞状上皮被柱状上皮替代，胃食管反流病时可见。胃食管反流病的靶器官是食管，不会对胃造成损伤，与胃癌（A错，为本题正确答案）的发病无关。